表面黄白色或淡棕黄色，质松泡，气微，味微甘的药材是
A. 玉竹
B. 山药
C. 桔梗
D. 地黄
E. 南沙参

正确答案：E。南沙参

解析：本题考查的是南沙参药材的鉴别。表面黄白色或淡棕黄色，质松泡，气微，味微甘的药材是南沙参（E对）。南沙参：【性状鉴别】药材呈圆锥形或圆柱形，略弯曲。表面黄白色或淡棕黄色，凹陷处常有残留粗皮，上部多有深陷横纹，呈断续的环纹，下部有纵纹及纵沟。顶端具1或2个根茎。体轻，质松泡，易折断，断面不平坦，黄白色，多裂隙。气微，味微甘。玉竹（A错）：【性状鉴别】药材呈长圆柱形，略扁，少有分枝。表面黄白色或淡黄棕色，半透明，具纵皱纹和微隆起的环节，有白色圆点状须根痕和圆盘状茎痕。质硬而脆或稍软，易折断，断面角质样或显颗粒性。气微，味甘，嚼之发黏。山药（B错）：【性状鉴别】药材毛山药略呈圆柱形，弯曲而稍扁。表面黄白色或淡黄色，有纵沟、纵皱纹及须根痕，偶有浅棕色的外皮残留。体重，质坚实，不易折断，断面白色，粉性。气微，味淡，微酸，嚼之发黏。桔梗（C错）：【性状鉴别】药材呈圆柱形或略呈纺锤形，下部渐细，有的有分支，略扭曲。表面淡黄色至黄色，不去外皮的表面黄棕色至灰棕色，具纵扭皱沟，并有横长的皮孔样斑痕及支根痕，上部有横纹。有的顶端有较短的根茎或不明显，其上有数个半月形茎痕。质脆，断面不平坦，横切面可见放射状裂隙，皮部黄白色，形成层环棕色，木部淡黄色。气微，味微甜后苦。地黄（D错）：【性状鉴别】药材鲜地黄呈纺锤形或条状。外皮薄，表面浅红黄色，具弯曲的纵皱纹、芽痕、横长皮孔样突起以及不规则疤痕。肉质、易断，断面皮部淡黄白色，可见橘红色油点，木部黄白色，导管呈放射状排列。气微，味微甜、微苦。